拔除上颌第一磨牙时需麻醉
A. 上牙槽中神经、腭前神经
B. 上牙槽后神经、腭前神经
C. 上牙槽中神经、上牙槽后神经
D. 上牙槽后神经、上牙槽中神经、鼻腭神经
E. 上牙槽后神经、上牙槽中神经、腭前神经

正确答案：E。上牙槽后神经、上牙槽中神经、腭前神经

解析：上颌神经在口腔的分布：①鼻腭神经：上颌321|123的腭侧黏骨膜和牙龈；②腭前神经：双侧上颌3～8的腭侧黏骨膜和牙龈；③上牙槽后神经：上颌78以及上颌6的腭根和远中颊根、牙周膜、牙槽骨和颊侧牙龈；④上牙槽中神经：上颌45以及上颌6的近中颊根、牙周膜、牙槽骨和颊侧牙龈；⑤上牙槽前神经：上颌1～3及其牙周膜、牙槽骨、唇侧牙龈。掌握“三叉神经的分支与分布”知识点。